当人群中患病率降低时
A. 阳性预测值升高
B. 阴性预测值升高
C. 两者均是
D. 两者均否

正确答案：B。阴性预测值升高

解析：本题考查阴性预测值。当灵敏度与特异度一定，疾病患病率降低，阳性预测值降低，阴性预测值升高（B对ACD错）。